属于润滑性泻药的是
A. 甘油（开塞露）
B. 聚乙二醇4000
C. 乳果糖
D. 酚酞
E. 硫酸镁

正确答案：A。甘油（开塞露）

解析：本题考查泻药。甘油（A对）为润滑性泻药；聚乙二醇4000（B错）为膨胀性泻药；乳果糖（C错）为渗透性泻药；酚酞（D错）为刺激性泻药；硫酸镁（E错）为容积性泻药。